男，58岁。胃部不适伴反酸20年，近1周来腹胀恶心呕吐，吐出大量宿食，每天1～2次。查体：呼吸浅，17次/分，血压正常。上腹部可见胃型，轻压痛。测血K⁺3.0mmol/L，Na⁺130mmol/L，Cl⁻90mmol/L，PaCO₂45mmol/L。该患者的酸碱平衡失调的类型是
A. 呼吸性碱中毒
B. 呼吸性酸中毒
C. 代谢性酸中毒
D. 呼吸性酸中毒+代谢性碱中毒
E. 代谢性碱中毒

正确答案：E。代谢性碱中毒

解析：患者有长期胃部不适病史，近一周腹胀、恶心，并吐出大量宿食，查体示上腹部可见胃型，提示出现幽门梗阻。幽门梗阻患者大量呕吐，K⁺、Na⁺、Cl⁻均随胃液丢失而降低（K⁺正常值为3.5～5.5mmol/L，Na⁺正常值为135～145mmol/L，Cl⁻正常值为98～106mmol/L），PaCO₂增高（PaCO₂即二氧化碳结合力，正常值22～31mmol/L）提示出现代谢性碱中毒（E对C错）（“短期内大量呕吐出现低钾、低氯性碱中毒”为常考考点）。患者呼吸系统未受影响，呼吸性碱中毒（A错）、呼吸性酸中毒（BD错）均不会出现。